门诊处方一般不超过几日
A. 1日常用量
B. 3日常用量
C. 7日常用量
D. 15日常用量
E. 30日常用量

正确答案：C。7日常用量

解析：本题考查处方用量。处方要求规定，门诊处方一般不得超过7日用量（C对）。急诊处方一般不得超过3日用量（B错）。必要情况下处方用量延长需要医师注明理由。